股骨颈骨折可分囊内、囊外骨折的原因是
A. 髋关节囊前面仅包裹股骨颈内侧1/3
B. 关节囊只包裹股骨颈的内侧1/2
C. 关节囊前面达转子间线，后面包裹股骨颈的内侧2/3
D. 关节囊未包裹股骨颈
E. 关节囊前面包裹股骨颈的内侧2/3

正确答案：C。关节囊前面达转子间线，后面包裹股骨颈的内侧2/3

解析：由于髋关节关节囊前面达转子间线，后面包裹股骨颈的内侧 2/3（C对），并未包裹全部股骨颈，所以骨折可发生在囊内、囊外。